主动脉弓的最后一个大分支是
A. 头臂干
B. 左颈总动脉
C. 左锁骨下动脉
D. 右锁骨下动脉
E. 右颈总动脉

正确答案：C。左锁骨下动脉

解析：从主动脉弓上发出的分支由右向左分别为头臂干、左颈总动脉和左锁骨下动脉。左锁骨下动脉（C对）为主动脉弓的最后一个大分支。